女，48岁。发热6天，头痛、乏力4天，尿少1天。于1月2日来诊。查体：T39℃，BP80/50mmHg，面部潮红，结膜充血，眼睑水肿，腋下有出血点。实验室检查：血WBC19×10⁹/L，尿蛋白（+++）。最可能的诊断是
A. 流行性脑脊髓膜炎
B. 肾综合征出血热
C. 急性肾小球肾炎
D. 钩端螺旋体病
E. 败血症

正确答案：B。肾综合征出血热

解析：48岁女性患者，发热6天，头痛乏力4天（肾综合征出血热发热期全身中毒症状），尿少1天（肾综合征出血热少尿期），于1月2日来诊（肾综合征出血热高发季节），查体T39℃，BP80/50mmHg（低血压），面部潮红，结膜充血，眼睑水肿，腋下有出血点（肾综合征出血热毛细血管损害征），实验室检查血WBC19×10⁹/L（成人正常参考值4～10×10⁹/L），尿蛋白（+++）（肾损害），根据患者的临床表现、个人史和实验室结果，最可能的诊断是肾综合征出血热（B对）。流行性脑脊髓膜炎（A错）多见于5岁以下小儿，常表现为高热、寒战、头痛呕吐，皮肤大片瘀斑，而非点状出血点，脑膜刺激征阳性等（P207）。急性肾小球肾炎（C错）主要表现为肾炎综合征即血尿、蛋白尿、水肿和高血压（八版内科学P469）。钩端螺旋体病（D错）常表现为发热、酸痛、全身软、眼红、腿痛、淋巴结肿大，有明显的腓肠肌疼痛，外周血白细胞总数和中性粒细胞轻度增高或正常（P253）。败血症（E错）临床表现无特异性，可反复出现的畏寒甚至寒战，高热可呈弛张型或间歇型，以瘀点为主的皮疹，累及大关节的关节痛，轻度的肝脾大，重者可有神志改变、心肌炎、感染性休克、DIC、呼吸窘迫综合征等，外周血白细胞升高，各种不同致病菌所引起的败血症，临床特点各不相同。流行性出血热发热期临床表现总结口诀如下：“发热三红醉酒貌，头腰眼痛像感冒，腋下鞭击出血点，恶心呕吐蛋白尿”。